男，64岁。突发心悸4小时就诊。心电图示：P波消失，代之以f波，心室率130次/分，节律绝对不规则。为减慢心室率，应选择的药物是
A. 美托洛尔
B. 阿托品
C. 沙丁胺醇
D. 利多卡因
E. 新斯的明

正确答案：A。美托洛尔

解析：患者老年男性，突发心悸4小时就诊，心电图示：P波消失，代之以f波（房颤的典型波形），心室率130次/分（正常值60～100次/分，心房颤动患者心室率常在100～160次/分），节律绝对不规则（心房颤动的典型体征），综合患者的临床表现、查体和心电图检查，考虑诊断为心房颤动。为减慢心室率，应选择的药物是美托洛尔（A对）。美托洛尔为选择性β₁受体拮抗剂，对心肌具有负性肌力、负性频率、负性传导的作用，是心房颤动患者减慢心室率的常见药物。阿托品（九版药理学P66）（B错）尚可缩短房室结的有效不应期，增加房颤或房扑患者的心室率。沙丁胺醇（九版药理学P292）（C错）为选择性β₂受体激动剂，能松弛支气管平滑肌，多用于支气管哮喘的治疗，可引起心动过速等不良反应。利多卡因（九版药理学P196）（D错）主要治疗室性心律失常，如心脏手术、心导管术、急性心肌梗死或强心苷中毒所致的室性心动过速或心室纤颤。新斯的明（九版药理学P60）（E错）为抗胆碱酯酶药，主要用于重症肌无力，腹部手术后肠麻痹等，也可用于治疗阵发性室上性心动过速，一般不用于房颤患者控制心室率。